某男性，48岁，身高175cm，体重80kg，患糖尿病3年余。如果他选择的是低GI食物，那么碳水化合物供能比最多可达
A. 0.4
B. 0.45
C. 0.5
D. 0.6
E. 0.65

正确答案：D。0.6

解析：本题考查糖尿病病人选择低GI食物的碳水化合物供能比。糖尿病病人碳水化合物的供给量以占总能量的45%～60%为宜，如选择低GI食物，碳水化合物供能比最多可达60%（D对ABCE错）。